肾挫伤的急诊处理是
A. 肾修补
B. 留置导尿
C. 手术探查
D. 肾穿刺引流
E. 严密观察，暂时保守治疗

正确答案：E。严密观察，暂时保守治疗

解析：大多数肾挫伤轻微，急诊处理时严密观察，暂时保守治疗（E对）即可。手术探查（C错）适用于开放性肾外伤的手术治疗。肾修补（A错）适用于闭合性肾外伤的手术治疗。肾穿刺引流（D错）适用于腹膜后尿囊肿或肾周脓肿。